处方药不得
A. 有涉及药品的宣传广告
B. 在大众传媒发布广告
C. 发布广告
D. 在零售药店销售
E. 在医学、药学专业刊物上介绍

正确答案：B。在大众传媒发布广告

解析：本题考查药品广告管理。处方药不得在大众传媒发布广告（B对）。处方药可以发布有涉及药品的宣传广告（AC错），但只准在专业性医药报刊进行广告宣传（E错），不得在大众传媒发布广告；处方药可以凭执业医师或执业助理医师处方在零售药店销售（D错）。